复发性口腔溃疡的临床特征不包括
A. 好发于中青年
B. 病程7～14天，有自限性
C. 多见于唇、颊、舌等非角化黏膜
D. 反复发作的溃疡为圆形或椭圆形，表面有黄色假膜，周围红晕
E. 病变可影响到口周皮肤

正确答案：E。病变可影响到口周皮肤

解析：本题考查复发性口腔溃疡的临床特征。溃疡发生于黏膜，不影响口周皮肤（E错，为本题的正确答案）。复发性口腔溃疡的临床特征有：女性的患病率一般高于男性，好发于中青年（A对）。复发性口腔溃疡一般表现为反复发作的圆形或椭圆形溃疡，具有黄、红、凹、痛的临床特征，及溃疡表面覆盖黄色假膜、周围有红晕带（D对）、中央凹陷、疼痛明显。溃疡好发于唇、舌、颊、软腭等无角化或角化较差的黏膜（C对）。约10-14天溃疡愈合，不留瘢痕（B对）。